妊娠合并糖尿病对孕妇的影响不正确的是
A. 产道损伤
B. 难产
C. 手术产率增高
D. 羊水过多
E. 对妊高症的发生率无影响

正确答案：E。对妊高症的发生率无影响